生态系统内形成的生态平衡，是何种性质的平衡
A. 自然的、动态的相对平衡
B. 封闭的绝对平衡
C. 间断性平衡
D. 波动式平衡
E. 永恒的开放式平衡

正确答案：A。自然的、动态的相对平衡

解析：本题考查生态平衡的性质。生态系统是由生物因素（包括人和其他生物）和非生物因素（主要指空气、水、土壤、阳光等）组成。生态系统内部的各种因素可能受到外部影响，引起内部平衡的破坏和结构变化。因此，生态系统的内部平衡性质是自然的、动态的相对平衡（A对BCDE错）。